关于融合牙的牙位的叙述，下列说法不正确的是
A. 乳牙列中多见下颌乳中切牙和乳侧切牙融合
B. 恒牙列中多见多生牙与正常牙融合
C. 乳牙列中多见下颌乳侧切牙与乳尖牙融合
D. 恒牙列中可见恒侧切牙与恒尖牙融合
E. 恒牙列中可见恒中切牙与恒侧切牙融合

正确答案：E。恒牙列中可见恒中切牙与恒侧切牙融合

解析：融合牙中在乳、恒牙列均可出现，乳牙列的融合牙比恒牙列多见。乳牙列多见下颌乳中切牙和乳侧切牙，或乳侧切牙和乳尖牙融合。恒牙列多为多生牙和正常牙融合，也见有恒侧切牙和恒尖牙融合。掌握“迟萌、多生牙和融合牙”知识点。